《药品经营质量管理规范》规定应对经营药品的质量负领导责任的是
A. 药品零售企业主要负责人
B. 药品零售企业专职质量管理人员
C. 药品零售企业中处方审核人员
D. 药品零售企业质量负责人
E. 药品零售企业法定代表人

正确答案：A。药品零售企业主要负责人

解析：本题考查企业负责人。《药品经营质量管理规范》规定应对经营药品的质量负领导责任的是药品零售企业主要负责人（A对）。《药品经营质量管理规范》第一百二十五条规定，企业负责人是药品质量的主要责任人，全面负责企业日常管理，负责提供必要的条件，保证质量管理部门和质量管理人员有效履行职责，确保企业实现质量目标并按照药品GSP的要求经营药品。